气管注入染毒适用于
A. 气体
B. 液体
C. 颗粒物
D. 蒸汽
E. 油性物

正确答案：C。颗粒物

解析：本题考查气管注入染毒的适用范围。气管注入染毒是一种毒素控制技术，它可以将染毒物质直接注入到气管中，以达到染毒的目的。它主要用于染毒颗粒物（C对），而不适用于气体（A错）、液体（B错）、蒸汽（D错）和油性物（E错）。